医学伦理学属于
A. 元伦理学
B. 描述伦理学
C. 境遇伦理学
D. 应用规范伦理学
E. 管理伦理学

正确答案：D。应用规范伦理学

解析：本题考查医学伦理学。医学伦理学属于应用规范伦理学（D对）。医学伦理学是指以医德为研究对象的一门科学，是人类尤其是医者认识医德生活的产物；是运用一般伦理学原理和主要准则，在解决医学实践中人们之间、医学与社会之间、医学与生态之间的道德问题而形成的学说体系；是医学与伦理学相互交叉的新兴学科，属于应用规范伦理学（D对CE错）的范畴。元伦理学（A错）是指研究伦理学本身，即对伦理学的性质、道德概念、道德逻辑分析和道德判断等进行研究，而不制定道德规范和价值标准,并且对任何道德规范、价值都采取中立立场的伦理学。描述伦理学（B错）是指对道德现象的研究既不涉及行为的善恶及其标准，也不谋求制定行为的准则或规范，只是依据其特有的学科立场和方法对道德现象进行经验性描述和再现的伦理学。